属于氰苷的是
A. 苦杏仁苷
B. 野樱苷
C. 二者皆可
D. 二者皆不可

正确答案：C。二者皆可

解析：本题考查的是苷类化合物概念。属于氰苷的是苦杏仁苷与野樱苷（C对）。苦杏仁苷（A错）与野樱苷（B错）均属于氰苷，野樱苷由苦杏仁苷失去一分子葡萄糖而成。氰苷：主要是指一类具有α-羟腈的苷，分布十分广泛。其特点是多数为水溶性，不易结晶，容易水解，尤其有酸和酶催化时水解更快。生成的苷元α-羟腈很不稳定，立即分解为醛（酮）和氢氰酸。而在碱性条件下苷元容易发生异构化。